关于腋神经的描述，何者是错误的
A. 发自臂丛后束
B. 与旋肩胛动脉伴行穿四边孔
C. 绕肱骨外科颈走行
D. 肌支支配三角肌和小圆肌
E. 肱骨外科颈骨折时可损伤该神经，呈方肩状畸形

正确答案：B。与旋肩胛动脉伴行穿四边孔

解析：腋神经发自臂丛后束（A对），与旋肱后血管伴行向后外方向，穿经腋窝后壁的四边孔后（B错，为本题正确选项），绕肱骨外科颈至三角肌深面（C对），发出分支支配三角肌和小圆肌（D对）。损伤后表现为臂不能外展，肩部和臂外上部皮肤感觉障碍。由于三角肌萎缩，病人肩部亦失去圆隆的外形（E对）。